关于生物学标志的叙述，错误的是
A. 又称为生物学标记或生物标志物
B. 检测样品可为血、尿、大气、水、土壤等
C. 检测指标为化学物质及其代谢产物和它们所引起的生物学效应
D. 分为接触生物学标志、效应生物学标志和易感性生物学标志三类
E. 生物学标志研究有助于危险性评价

正确答案：B。检测样品可为血、尿、大气、水、土壤等